牙冠桩核修复后折断，那么此种情况进行冠修复指的是
A. 修复体脱落
B. 穿孔金属修复体
C. 折断牙冠部分的桩
D. 烤瓷冠大范围破损崩瓷
E. 前牙烤瓷冠局部崩瓷缺损

正确答案：C。折断牙冠部分的桩

解析：对于折断牙冠部分的桩，如桩固位良好不易拆除，可在残留桩上制作树脂核，然后做冠修复。掌握“修复体戴入后的问题及处理”知识点。